反映肝纤维化的血清学指标是
A. 胆固醇
B. 乳酸脱氢酶（LDH）
C. γ-谷氨酰转肽酶（γ-GT，GGT）
D. 白蛋白
E. 胆汁酸

正确答案：C。γ-谷氨酰转肽酶（γ-GT，GGT）

解析：用于评价肝纤维化的实验诊断指标目前主要有两类：一类是反映胶原产生及降解的血清标志物：MAO、PH、PⅢP、Ⅵ型胶原及其降解片段等、透明质酸（HA）、层粘连蛋白等；另一类是通过测定血清多种非胶原相关成分，然后计算肝纤维化分数，如Fibrotest（测定Apo A1、结合珠蛋白、α₂-微球蛋白、γ-GT（C对））、ELF-test（测定组织金属蛋白酶抑制剂-1、PⅢP、透明质酸）、Hepascore（测定胆红素、γ-GT、α₂-微球蛋白、透明质酸、性别及年龄）、Wai-score（测定ALT、AST、PLT）。本题答案选C。胆固醇（A错）主要用于识别早期动脉粥样硬化的危险性和使用降脂药物治疗后的监测。乳酸脱氢酶（LDH）（B错）存在人体多种细胞中，对于肝硬化的诊断灵敏度高，特异性差。胆汁酸（E错）升高见于多种肝脏细胞损伤的疾病，不作为反映肝纤维化的血清学指标。